慢性肾小球肾炎的主要发病机制是
A. 链球菌感染
B. 病毒感染
C. 感染后免疫损害
D. 毛细血管脆性增加
E. 肝脏解毒功能下降

正确答案：C。感染后免疫损害

解析：各种不同类型的慢性肾小球肾炎的发病机制起始因素多为免疫介导炎症反应，及感染后免疫损害（C对）。链球菌感染为急性肾炎的发病机制（A错）。肝脏解毒功能下降为肾小球肾炎的结果或加重的原因（E错）。病毒感染（B错）、毛细血管脆性增加（D错）为与慢性肾小球肾炎无关。